女性，22岁，因右下智齿低位埋伏阻生，要求拔除。为减少出血，保持术野清晰，常在麻药中加入
A. 肾上腺素
B. 立止血
C. 安络血
D. 止血敏
E. 止血芳酸

正确答案：A。肾上腺素

解析：本题考查局麻药中血管收缩剂的应用。为了减少出血，保持术野清晰，常在局麻药中加入肾上腺素（A对）。立止血用于需减少流血或止血的各种医疗情况下，如：外科、内科、妇产科、眼科、耳鼻喉科、口腔科等临床科室的出血及出血性疾病；一般为静脉注射或肌肉注射，不加入局麻药中使用（B错）。安络血适用于因毛细血管损伤及通透性增加所致的出血，如鼻衄、视网膜出血、咯血、胃肠出血、血尿、痔疮及子宫出血等。也用于血小板减少性紫癜，但止血效果不十分理想。（C错）。止血敏用于防治各种手术前后的出血，也可用于血小板功能不良、血管脆性增加而引起的出血，亦可用于呕血、尿血等；用法为肌内注射或静脉注射（D错）。止血芳酸主要用于因原发性纤维蛋白溶解过度所引起的出血，包括急性和慢性、局限性或全身性的高纤溶出血；用法为静脉注射或滴注（E错）。